影响病例对照研究样本量的主要因素不包括
A. 人群中暴露者的比例
B. 估计的暴露的相对危险度
C. 要求的显著性水平
D. 要求的把握度
E. 研究变量的性质

正确答案：E。研究变量的性质

解析：本题考查影响病例对照研究样本量的主要因素。影响病例对照研究样本量的主要因素包括：①研究因素在对照组或人群中的暴露率（P₀）（A对）。②预期的该因素引起的相对危险度（RR）（B对）或暴露的比值比（OR）。③希望达到的统计学检验假设的显著性水平（C对），即第Ⅰ类错误（假阳性）概率（α），一般取α＝0.05。④希望达到的统计学检验假设的效能或称把握度（1－β）（D对），β为第Ⅱ类错误（即假阴性）概率，一般取β＝0.1。研究变量的性质（E错，为本题正确答案）不会影响病例对照研究的样本量。